发生于治疗后的牙齿的牙髓炎症为
A. 逆行性牙髓炎
B. 残髓炎
C. 牙本质敏感
D. 可复性牙髓炎
E. 慢性增生性牙髓炎

正确答案：B。残髓炎

解析：残髓炎发生在经牙髓治疗后的患牙。掌握“残髓炎及逆行性牙髓炎”知识点。